患者，女，60岁，因患哮喘服用氨茶碱缓释剂，近日，因胃溃疡服用西咪替丁，三日后出现心律失常、心悸、恶心等症状。将西咪替丁换成法莫替丁后，上述症状消失，引起该患者心律失常及心悸等症状的主要原因是
A. 西咪替丁与氨茶碱竞争血浆蛋白
B. 西咪替丁抑制肝药酶，减慢了氨茶碱的代谢
C. 西咪替丁抑制氨茶碱的肾小管分泌
D. 西咪替丁促进氨茶碱的吸收
E. 西咪替丁增强组织对氨茶碱的敏感性

正确答案：B。西咪替丁抑制肝药酶，减慢了氨茶碱的代谢

解析：本题考查影响药物代谢的作用形式。西咪替丁是酶抑制剂，减少氨茶碱的代谢（B对）。酶的抑制可以减少肝药酶活性，代谢减慢，使受影响的药物作用加强或延长。包括氯霉素，西咪替丁，异烟肼，胺碘酮，红霉素，甲硝唑，咪康唑，哌醋甲酯，磺吡酮，三环类抗抑郁药，吩噻嗪类药物等。